规定医疗机构和医务人员不得实施任何形式的代孕技术的伦理原则于哪一年开始实施
A. 2000
B. 2001
C. 2002
D. 2003
E. 2004

正确答案：D。2003